人体试验中切实保护受试者利益，下列除哪一项外，均对
A. 人体试验前必须以做过动物试验为前提
B. 人体试验前必须制定严密科学计划
C. 人体试验前必须有严格的审批监督程序
D. 人体试验前必须详细了解病人身心情况
E. 人体试验结束后必须做出科学报告

正确答案：D。人体试验前必须详细了解病人身心情况

解析：保护受试者原则不包括人体试验前必须详细了解病人身心情况（D错，为本题正确答案）。保护受试者原则具体要求包括：必须以充分的、确认对动物无明显毒害作用的动物实验为基础（A对）；确保人体试验方案设计、试验程序严谨科学（B对）；在人体试验的全过程要有充分、有效的安全防护措施以处置各种不良事件；必须有严格的审批监督程序（C对），须在具有相当学术水平和临床经验丰富的医学科研工作者的亲自参与和指导下进行；试验结束后必须做出科学报道（E对）。